下列切口不宜放置纱条引流的是
A. 腹壁切口感染
B. 脓性指头炎切开
C. 掌中间隙脓肿切开
D. 体表脓肿切开
E. 乳腺癌改良根治术

正确答案：E。乳腺癌改良根治术

解析：外科引流的绝对适应证是软组织的感染性病变如脓肿、痈、创面感染、切口感染等，也可在软组织手术预期有较多量渗血或渗出液时作预防性引流。对软组织感染创面所采用的引流方法为放置纱布条引流。而预防性引流则多采用开放式或半开放式管道引流，通常指橡胶引流管。腹壁切口感染（A对）、脓性指头炎切开（B对）、掌中间隙脓肿切开（C对）、体表脓肿切开（D对）都属于软组织感染性病变，宜放置纱布条引流。而乳腺癌改良根治术（E错，为本题正确答案）中的引流为预防性引流，应该使用负压引流管引流。